橘红丸除清肺、化痰外，又能
A. 止咳
B. 通便
C. 散风
D. 平喘
E. 祛瘀

正确答案：A。止咳

解析：本题考查的是橘红丸的功能。橘红丸除清肺、化痰外，又能止咳（A对）。橘红丸：【功能】清肺，化痰，止咳。清肺抑火丸：【功能】清肺止咳，化痰通便（B错）。芎菊上清丸：【功能】清热解表，散风（C错）止痛。小青龙胶囊：【功能】解表化饮，止咳平喘（D错）。蠲哮片：【功能】泻肺除壅，涤痰祛瘀（E错），利气平喘。